流脑发病主要由哪项引起
A. 肠毒素
B. 细胞毒素
C. 神经毒素
D. 内毒素
E. 类毒素

正确答案：D。内毒素

解析：流行性脑脊髓膜炎是由脑膜炎球菌引起的急性化脓性脑膜炎。脑膜炎球菌释放的内毒素（D对ABCE错）是本病致病的重要因素。内毒素引起全身的施瓦茨曼反应，激活补体，血清炎症介质明显增加，产生循环障碍和休克。脑膜炎球菌内毒素较其他内毒素更易激活凝血系统，因此在休克早期便出现弥漫性血管内凝血及继发性纤溶亢进，进一步加重微循环障碍、出血和休克，最终导致多脏器功能衰竭。细菌侵犯脑膜，进入脑脊液，释放内毒素引起脑膜和脊髓膜化脓性炎症及颃内压升高，出现惊厥、昏迷等症状。严重脑水肿时形成脑疝，可迅速致死。